能增强磺胺类药物抗菌作用的药物是
A. 呋喃唑酮
B. 甲氧苄啶
C. 氧氟沙星
D. 磺胺嘧啶
E. 甲硝唑

正确答案：B。甲氧苄啶

解析：甲氧苄啶与磺胺合用可使细菌叶酸代谢受到双重阻断，抗菌作用增加数倍至数十倍，甚至出现杀菌作用（B对）。